急性肾衰竭是指
A. 泌尿功能障碍
B. 产生氮质血症
C. 肾功能急剧障碍引起代谢产物蓄积及机体内环境紊乱
D. 代谢废物排出障碍
E. 激素产生障碍

正确答案：C。肾功能急剧障碍引起代谢产物蓄积及机体内环境紊乱

解析：急性肾衰竭是指肾功能急剧障碍引起代谢产物蓄积及机体内环境紊乱（C对）。